有牙龈萎缩者下列哪种刷牙方法最好
A. 轻刷法
B. 水平颤动法
C. 竖转动法
D. 重刷法
E. 横刷法

正确答案：C。竖转动法

解析：本题考查刷牙的方法。竖转动法用于牙龈有退缩者（C对）。水平颤动拂刷法是一种有效清除龈沟内和牙面菌斑的刷牙方法，主要用于去除牙颈部及龈沟内的菌斑，拂刷主要是清除唇颊舌侧的菌斑（B错）。轻刷（A错）、重刷（D错）为刷牙的力度，不是刷牙的方式。横刷法是错误的刷牙方式，易造成楔状缺损（E错）。